下列关于颊粘膜癌的描述中，不正确的是
A. 常发生于磨牙区附近
B. 小的颊黏膜鳞癌可采用放射治疗
C. 多为低度分化的鳞癌
D. 常转移至下颌下及颈深上淋巴结
E. 切除后如创面过大可用颊脂垫、带蒂皮瓣或游离皮瓣转移整复

正确答案：C。多为低度分化的鳞癌

解析：颊黏膜癌也是常见的口腔癌之一，在口腔癌中居第二或第三位。多为分化中等的鳞状细胞癌，少数为腺癌及恶性多形性腺瘤。掌握“颊癌、口底癌及唇癌”知识点。